下列心脏杂音的产生机制，正确的是
A. 只要血流速度加快，即使没有血管狭窄也可产生杂音
B. 随着血液粘稠度的增加，不仅产生杂音而且强度增大
C. 没有瓣膜病变者，当血流速度减慢时也可产生杂音
D. 瓣膜口狭窄越严重，产生的杂音越强
E. 动脉壁局限性扩张时，血流速度减慢而不产生杂音

正确答案：A。只要血流速度加快，即使没有血管狭窄也可产生杂音

解析：正常血流呈层流状态，在血流加速，异常血流通道，血管管径异常等情况下，可使层流转变为湍流或漩涡冲击心壁，大血管壁，瓣膜，腱索等使之震动而在相应部位产生杂音。根据泊肃叶定律（生理学P118），即使没有血管狭窄（管腔直径一定），血流速度加快也能使层流变成湍流，从而产生杂音（A对）。血液粘稠度增加，根据雷诺公式（生理学P118）更容易产生湍流，更容易产生杂音，但是根据泊肃叶定律（生理学P118），在血管长度，管腔半径，压强差一定的情况下，血流量与黏度成反比，即血黏增加，血流量减少，进而杂音强度减小。所以只有血液粘稠度增加而没有血管狭窄作为条件情况下，难以产生血管杂音（B错）。在没有血管狭窄和血流加快这两个条件下，湍流难以形成，难以产生血管杂音。所以在没有瓣膜病变的情况下，血流减慢，难以产生血管杂音（C错）。当瓣膜口阻塞程度较高时，血流减少甚至中断，血流冲击力减小，杂音强度会减小（D错）。动脉局限扩张时，会改变原有的层流状态，新产生的湍流和漩涡撞击血管壁，也可产生杂音（E错）。